以上属腮腺特异性感染的疾病是
A. 急性化脓性腮腺炎
B. 慢性复发性腮腺炎
C. 流行性腮腺炎
D. 舍格伦综合征
E. 腮腺放线菌病

正确答案：E。腮腺放线菌病

解析：本题考查腮腺特异性感染的疾病。较常见的唾液腺特异性感染有结核病、放线菌病、HIV相关唾液腺疾病等。腮腺放线菌病（E对）为发生在腮腺的放线菌病，属于腮腺特异性感染疾病。急性化脓性腮腺炎（A错）是唾液腺的化脓性炎症。慢性复发性腮腺炎（B错）主要表现为腮腺反复肿胀，属于唾液腺炎症的一种。流行性腮腺炎（C错）是由于副黏液病毒感染引起的炎症性疾病。舍格伦综合征（D错）是一种自身免疫性疾病，确切病因及发病机制尚不十分明确。